县级以上卫生行政部门按照《麻醉药品和精神药品管理条例》第73条的规定予以处罚的行为
A. 未取得麻醉药品处方资格的医师擅自开具麻醉药品
B. 未取得第一类精神药品处方资格的医师擅自开具第一类精神药品处方
C. 具有麻醉药品和第一类精神药品处方医师未按照规定开具麻醉药品和第一类精神药品处方
D. 未按照卫生部制定的麻醉药品和精神药品临床应用指导原则使用麻醉药品和第一类精神药品
E. 以上说法均正确

正确答案：E。以上说法均正确

解析：医师出现下列情形之一的，由县级以上卫生行政部门按照《麻醉药品和精神药品管理条例》第73条的规定予以处罚：①未取得麻醉药品和第一类精神药品处方资格的医师擅自开具麻醉药品和第一类精神药品处方的；②具有麻醉药品和第一类精神药品处方医师未按照规定开具麻醉药品和第一类精神药品处方，或者未按照卫生部制定的麻醉药品和精神药品临床应用指导原则使用麻醉药品和第一类精神药品的。掌握“处方的开具、监督管理及法律责任”知识点。